对生产环境进行监测属于
A. 自然因素
B. 社会因素
C. 生活方式因素
D. 生物学因素
E. 医疗卫生服务因素

正确答案：B。社会因素